为确定诊断首选的检测项目是
A. 血培养
B. 粪便培养
C. 骨髓培养
D. 胆汁培养
E. 尿液培养

正确答案：A。血培养

解析：肥达氏反应O抗体1：80，H抗体l：160可以得出伤寒沙门菌感染，患者出现症状10天，在2周内，（P120）图9-3可得知，发病后2周内血培养的结果更可靠，采用血培养（A对），发病2周后采用粪便培养（B错），骨髓培养第1周至第3周均可取，但不为首选（C错），发病三周后采用尿液培养（E错），一般不采用胆汁培养（D错）。